心包摩擦音和胸膜摩擦音的鉴别要点是
A. 有无心脏病史
B. 呼吸是否增快
C. 改变体位后摩擦音是否消失
D. 屏住呼吸后摩擦音是否消失
E. 咳嗽后摩擦音是否消失

正确答案：D。屏住呼吸后摩擦音是否消失

解析：心包摩擦音和胸膜摩擦音的鉴别要点是屏住呼吸后摩擦音是否消失（D对），胸膜摩擦音吸气和呼气相均可听到，以吸气末或呼气开始最为明显，屏气即消失；心包摩擦音常在胸骨左缘第四肋间触及，屏气后不消失。有无心脏病史（A错）、呼吸是否增快（B错）、改变体位后摩擦音是否消失（C错）、咳嗽后摩擦音是否消失（E错）不是心包摩擦音和胸膜摩擦音的鉴别要点。